当患者口腔前庭的深度不足时或基牙下存在软组织倒凹时应选用
A. 间隙卡
B. 尖牙卡环
C. RPI卡环
D. RPA卡环
E. 三臂卡环

正确答案：D。RPA卡环

解析：RPA卡环组：RPA卡环组与RPI卡环组不同点是以圆环形卡环的固位臂代替I杆，目的是为克服RPI卡环组的某些不足之处。例如：当患者口腔前庭的深度不足时或基牙下存在软组织倒凹时不宜使用RPI卡环组，可应用RPA卡环组。掌握“局部义齿固位体”知识点。